牙面未仔细干燥，尚有水分，若此时充填，则会引起树脂充填修复
A. 牙周性疼痛
B. 牙髓性疼痛
C. 充填物折裂、松脱
D. 继发龋
E. 牙体折裂

正确答案：C。充填物折裂、松脱

解析：牙面未仔细干燥，尚有水分，占据脱矿孔隙，妨碍粘接剂渗入釉柱孔隙内，也影响粘接性能。此项因素对粘接影响大，值得特别重视。可能导致充填体折裂、松脱。掌握“龋病治疗出现问题及处理”知识点。